常发生于磨牙区附近，按UICC的规定应在上下颊沟之间，翼下颌韧带之前，并包括唇内侧黏膜的是
A. 舌癌
B. 颊癌
C. 皮肤癌
D. 口底癌
E. 中央性颌骨癌

正确答案：B。颊癌

解析：颊黏膜癌的区域，按UICC的规定应在上下颊沟之间，翼下颌韧带之前，并包括唇内侧黏膜。常发生于磨牙区附近，呈溃疡型或外生型，生长较快，向深层浸润。掌握“颊癌、口底癌及唇癌”知识点。